不属于成分输血的优点的是
A. 减少免疫反应
B. 提高疗效
C. 减少输血反应
D. 降低心脏负荷
E. 有效改善血容量

正确答案：E。有效改善血容量

解析：成分输血是与输全血相对应的，二者均可有效改善血容量（E错，为本题正确答案），故不属于成分输血的优点。输全血时有大量异体抗原进入机体，易发生输血反应（包括免疫反应），成分输血（如洗涤红细胞）则可避免（AC对）。相同容量的成分血中有效成分更多，如浓缩红细胞、血小板制剂、血浆等，一方面可以提高疗效（B对），另一方面可以降低心脏负荷（D对）。